片剂包衣的主要目的和效果包括
A. 掩盖药物苦味或不良气味，改善用药顺应性
B. 防潮，遮光，增加药物稳定性
C. 用于隔离药物，避免药物的配伍变化
D. 控制药物在胃肠道的释放部位
E. 改善外观，提高流动性和美观度

正确答案：A、B、C、D、E。掩盖药物苦味或不良气味，改善用药顺应性；防潮，遮光，增加药物稳定性；用于隔离药物，避免药物的配伍变化；控制药物在胃肠道的释放部位；改善外观，提高流动性和美观度

解析：本题考查片剂的包衣。片剂包衣的主要目的如下：①掩盖药物的苦味或不良气味，改善用药顺应性（A对），方便服用；②防潮，避光，以增加药物的稳定性（B对）；③可用于隔离药物，避免药物间的配伍变化（C对）；④改善片剂的外观，提高流动性和美观度（E对）；⑤控制药物在胃肠道的释放部位（D对），实现胃溶、肠溶或缓控释等目的。